根据药品飞行检查的有关规定，如果发现甲药品生产企业锁闭大门，阻止检查员进入生产车间，甲的行为属于
A. 拒绝配合检查员取证
B. 限制检查时间
C. 以故意停止经营的方式欺骗检查
D. 限制检查员进入被检查场所

正确答案：D。限制检查员进入被检查场所

解析：本题考查飞行检查结果的处理。根据药品飞行检查的有关规定，如果发现甲药品生产企业锁闭大门，阻止检查员进入生产车间，甲的行为属于限制检查员进入被检查场所（D对）。药品监督管理部门有权在任何时间进入被检查单位研制、生产、经营、使用等场所进行检查，被检查单位不得拒绝、逃避。被检查单位有下列情形之一的，视为拒绝、逃避检查：①拖延、限制、拒绝检查人员进入被检查场所或者区域的，或者限制检查时间（B错）的；②无正当理由不提供或者延迟提供与检查相关的文件、记录、票据、凭证、电子数据等材料的；③以声称工作人员不在、故意停止生产经营等方式欺骗（C错）、误导、逃避检查的；④拒绝或者限制拍摄、复印、抽样等取证工作的（A错）；⑤其他不配合检查的情形。